有关牙内陷治疗方法说法中，正确的是
A. 早期应按深龋处理
B. 预后不佳者应予拔除
C. 必要时可拔除患牙再修复
D. 牙髓、牙周同时发病者行根管治疗术同时行牙周病手术治疗
E. 以上说法均正确

正确答案：E。以上说法均正确

解析：对牙内陷的治疗，应视其牙髓是否遭受感染而定。①早期应按深龋处理，将空腔内软化组织去净并形成洞形，按间接盖髓术处理。②若已出现牙髓和牙周疾病，则根据牙髓状态、牙根发育情况和牙周组织受累情况，选择进一步处理的方法。凡导致牙髓、牙周同时发病者，应在行根管治疗术的同时行牙周病手术治疗。③若牙齿外形也有异常，必要时可拔除患牙再修复。若裂沟已达根尖部，由于相互交通造成牙周组织广泛破坏，则预后不佳，应予拔除。掌握“牙内陷”知识点。